男，70岁。1天前因股骨颈骨折住院，今日突发呼吸困难，大汗，既往体健。查体：T36.5℃，BP90/60mmHg，无颈静脉怒张，双肺呼吸音清，未闻及干湿啰音，心率100次/分，P₂亢进伴分裂，肝肋下未及，双下肢无水肿。心电图提示电轴右偏，SⅠQⅢTⅢ。血清肌钙蛋白阴性。该患者最可能的诊断是
A. 急性心力衰竭
B. 急性心肌梗死
C. 肺动脉栓塞
D. 急性呼吸窘迫综合症
E. 吸入性肺炎

正确答案：C。肺动脉栓塞

解析：该患者为老年男性，患有股骨颈骨折（为静脉血栓栓塞症的危险因素），突发呼吸困难、大汗，查体见低血压、无颈静脉怒张、P亢进伴分裂，心电图提示提示电轴右偏（右心肥大的改变），SⅠQⅢTⅢ征，且血清肌钙蛋白为阴性，根据其临床表现和辅助检查，考虑诊断为肺动脉栓塞（C对）。急性心力衰竭（P174）（A错）常表现为突发呼吸困难，大汗，同时频繁咳嗽，咳粉红色泡沫样痰，听诊时两肺布满湿性啰音和哮鸣音。急性心肌梗死（P236）（B错）可根据其典型心绞痛的病史、典型的缺血性心电图表现（即新发或一过性ST段压低≥0.1mV，或T波倒置≥0.2mV），以及心肌损伤标志物（肌钙蛋白等阳性）做出诊断。急性呼吸窘迫综合症（P131）（D错）大多数于原发病起病后72小时内发生，临床表现为顽固性低氧血症、呼吸频数和呼吸窘迫，且咳出血水样痰是ARDS的典型症状之一，早期肺部体征较少，中晚期可听到干性或湿性啰音，心电图常无特异性改变。吸入性肺炎（E错）多见于儿童或神志不清的患者，常有吸入诱因史，吸入后可突发吸气性困难，出现严重低氧血症，常咳出浆液性泡沫状痰，两肺可闻及湿罗音和哮鸣音，该患者无吸入诱因史，双肺呼吸音清。